与细菌毒力有关的质粒是
A. F质粒
B. R质粒
C. Vi质粒
D. Col质粒
E. γ决定因子

正确答案：C。Vi质粒